牙槽嵴重建术20世纪70年代较好的骨组织替代材料为
A. 磷灰石颗粒
B. 碳酸钙颗粒
C. 石灰石颗粒
D. 羟基磷灰石颗粒
E. 锶羟基磷灰石颗粒

正确答案：D。羟基磷灰石颗粒

解析：本题考查牙槽嵴重建术的材料。牙槽嵴重建术20世纪70年代较好的骨组织替代材料为羟基磷灰石颗粒（D对）。碳酸钙颗粒（B错）为抗酸剂和补钙药，参与骨骼的形成、骨折后骨组织再建、肌肉收缩、神经传递、凝血、毛细血管通透性的维持等生理机制。牙槽嵴重建术20世纪60～70年代主要的重建方法为自体骨移植加高术，但由于移植骨不断地吸收及重建牙槽嵴形态不理想而逐渐被弃用，20世纪70年代以来生物材料羟基磷灰石颗粒增高或重建牙槽骨成为较好的骨组织替代材料（ACE错）。